调节酶所发生的化学修饰中最多见的是
A. 腺苷化修饰
B. 乙酰化修饰
C. 甲基化修饰
D. 磷酸化修饰
E. 去甲基化修饰

正确答案：D。磷酸化修饰

解析：调节酶所发生的共价修饰有多种形式，如磷酸化、甲基化、乙酰化等，其中以磷酸化修饰为最多见。掌握“酶活性调节（抑制与激活）”知识点。